女，50岁。车祸致腹部损伤3小时。伤后腹痛、腹胀。在急诊室非手术治疗观察期间，最重要的措施是
A. 实验室检查的动态监测
B. 全面了解损伤经过
C. 腹部X线检查
D. 腹部B超的动态检查
E. 观察腹部体征的变化

正确答案：E。观察腹部体征的变化

解析：50岁女性患者，车祸致腹部损伤3小时（腹部闭合性损伤），伤后腹痛、腹胀，在急诊室非手术治疗观察期间，最重要的措施是观察腹部体征的变化（E对），观察期间要反复检查伤情，并根据变化，不断综合分析，尽早作出结论而不致贻误治疗。实验室检查的动态监测（A错）也属于观察内容，用于辅助了解病情情况，但不是最重要的措施。腹部X线检查（C错）、腹部B超的动态检查（D错）在病情需要时进行。全面了解损伤经过（B错）为入院后需立即了解的内容，能为诊断提供最主要依据，不属于观察期间的重要措施。